长期饥饿时糖异生的生理意义之一是
A. 有利于必需氨基酸合成
B. 有利于排钠保钾
C. 有利于脂酸合成
D. 有利于补充血糖
E. 有利于脂肪合成

正确答案：D。有利于补充血糖

解析：长期饥饿时糖异生的生理意义之一有利于补充血糖（D对），其原料为乳酸、生糖氨基酸和甘油，此时脂肪和脂酸的合成减少、消耗增多（CE错）。即使在长期饥饿状况下，机体也需消耗一定量的葡萄糖，以维持生命活动，此时这些葡萄糖全部依赖于糖异生生成。必需氨基酸（P197）不能在体内合成（A错）。糖异生与排钠保钾无关（B错）。